人造冠龈边缘必须高度磨光的主要理由是
A. 减小对牙龈的刺激
B. 患者舒服
C. 加强抗力
D. 加强固位
E. 美观

正确答案：A。减小对牙龈的刺激

解析：人造冠龈边缘必须高度磨光的主要理由是减小对牙龈的刺激，如果边缘处理不当容易造成局部组织压迫，菌斑滞留等问题从而导致牙周组织破坏。掌握“修复体试戴、磨光与粘固”知识点。